左心室
A. 内有室上嵴
B. 左上部为动脉圆锥
C. 流出道与肺动脉口相延续
D. 前内侧部为主动脉前庭
E. 内有隔缘肉柱

正确答案：D。前内侧部为主动脉前庭

解析：室上嵴位于右心室（A错）内。动脉圆锥位于右心室（B错）内。左心室流出道与主动脉口（C错）相延续。前内侧部为主动脉前庭（D对）即左心室流出道。隔缘肉柱位于右心室（E错）内。